肺炎病原体最不常见的入侵途径是
A. 血行播散
B. 邻近部位蔓延
C. 定植菌误吸
D. 飞沫吸入
E. 淋巴道感染

正确答案：E。淋巴道感染

解析：肺炎病原体可经过血行播散（A对）、邻近感染部位蔓延（B对）、上呼吸道定植菌的误吸（C对）、空气吸入（D对）的方式入侵，很少通过淋巴道感染（E错，为本题正确答案）。